在发布广告时应显示忠告语“请按药品说明书或在药师指导下购买和使用”的是
A. 基本药物
B. 非处方药
C. 医疗机构配制的制剂
D. 处方药

正确答案：B。非处方药

解析：本题考查药品广告发布的内容准则。在发布广告时应显示忠告语“请按药品说明书或在药师指导下购买和使用”的是非处方药（B对）。药品广告的内容应当以国务院药品监督管理部门核准的说明书为准。药品广告涉及药品名称、药品适应症或者功能主治、药理作用等内容的，不得超出说明书范围。药品广告应当显著标明禁忌、不良反应，处方药（D错）广告还应当显著标明“本广告仅供医学药学专业人士阅读”，非处方药广告还应当显著标明非处方药标识（OTC）和“请按药品说明书或者在药师指导下购买和使用”。医疗机构配制的制剂（C错）不得在市场上销售，不得发布医疗机构制剂广告。